前壁心肌梗死并发短阵室速时宜选择的治疗药物为
A. 地尔硫草（硫氮䓬酮）
B. 洋地黄
C. 阿托品
D. 利多卡因
E. 胺碘酮

正确答案：D。利多卡因

解析：利多卡因（九版药理学P196）（D对）主要治疗室性心律失常，如心脏手术、心导管术、急性心肌梗死或强心苷中毒所致的室性心动过速或心室纤颤。故应为本例选择治疗药物。地尔硫䓬（硫氮䓬酮）（A错）为钙通道阻滞剂，适用于治疗室上性心动过速及后除极触发活动所致的心律失常（九版药理学P189）。洋地黄（P172）（B错）主要用于伴有快速心房颤动/心房扑动的收缩性心力衰竭。阿托品（C错）主要用于阻滞部位在房室结的房室传导阻滞，可提高心室率。胺碘酮（P206）（E错）主要用于各种室上性快速性心律失常和有器质性病变的室性心律失常。急性心肌梗死频发多源性室早时应首选胺碘酮治疗。